以下哪种药物有抗腺病毒、疱疹病毒和呼吸道合胞病毒的作用
A. 利福平
B. 异烟肼
C. 氯喹
D. 利巴韦林
E. 青蒿素

正确答案：D。利巴韦林

解析：利巴韦林有抗腺病毒、疱疹病毒和呼吸道合胞病毒的作用。掌握“氟康唑、利巴韦林及阿昔洛韦”知识点。